药师在提供药物信息咨询服务时常需查阅各种资料。除药品说明书外，查询妊娠及哺乳期用药可首选的书籍是
A. 《新编药物学》
B. 《药物治疗学》
C. 《中华人民共和国药典》
D. 《药物流行病学》
E. 《注射药物手册》

正确答案：B。《药物治疗学》

解析：本题考查药物信息咨询服务常用资料。《药物治疗学》（B对）主要对疾病的病理生理学、流行病学和治疗方法等诸多内容进行详细阐述，因此查询妊娠及哺乳期用药可以选择的书籍是《药物治疗学》。《新编药物学》（A错）是介绍国内外常用药品的性状、药理及应用、用法、注意事项及制剂的书籍。《中华人民共和国药典》（C错）是查询药品质量标准的首选书籍。《药物流行病学》（D错）是将流行病学与临床实践紧密结合的书籍。《注射药物手册》（E错）是查询输液剂的配伍禁忌的首选书籍。